正气不足，邪气亢盛形成的病证是
A. 实证
B. 虚证
C. 虚实夹杂证
D. 真虚假实证
E. 真实假虚证

正确答案：C。虚实夹杂证

解析：虚实夹杂，指在疾病的过程中，邪盛和正虚同时存在的病机变化（C对）。实证是指邪气亢盛为矛盾的主要方面的病机变化（A错）。虚证是指正气不足，以正气虚损为矛盾主要方面的病机变化（B错）。真虚假实证是指病机的本质为“虚”，但表现出“实”的临床假象（D错）。真实假虚证是指病机的本质是“实”，但表现出“虚”的临床假象（E错）。